骨盆骨折易造成
A. 肾损伤
B. 尿道球部损伤
C. 尿道膜部损伤
D. 尿道前列腺部损伤
E. 尿道球膜部交界处损伤

正确答案：C。尿道膜部损伤

解析：骨盆骨折容易伤及后尿道，最易伤及尿道膜部（C对），严重时可伤及前列腺部尿道（D错）。尿道球部（B错）损伤多见于骑跨伤，肾损伤（A错）和尿道球膜部交界处损伤（E错）在骨盆骨折中较少见。